用煮法炮制降低毒性的中药有
A. 巴豆
B. 吴茱萸
C. 附子
D. 川乌
E. 马钱子

正确答案：B、C、D。吴茱萸；附子；川乌

解析：本题考查的是煮制的目的。用煮法炮制降低毒性的中药有吴茱萸（B对）、附子（C对）、川乌（D对）。煮制的目的：①清除或降低药物的毒副作用，如川乌、附子等。②清洁药物，如珍珠等。吴茱萸：【炮制方法】处方用名有吴茱萸、制吴茱萸。①吴茱萸：取原药材，除去杂质，洗净，干燥。②制吴茱萸：取甘草片或碎块，加适量水，煎汤去渣，加入净吴茱萸，闷润吸尽后置锅内，用文火炒至微干，取出，晒干。③盐吴茱萸：取净吴茱萸，置于适宜容器内，加入盐水拌匀，置锅内用文火加热，炒至裂开，稍微鼓起时，取出放凉。【炮制作用】吴茱萸味辛、苦，性热；有小毒。归肝、脾、胃、肾经。具有散寒止痛，降逆止呕，助阳止泻的功能。①生品有小毒，多外用。以散寒定痛力强，用于口腔溃疡，牙痛，湿疹。②制吴茱萸，能降低毒性，缓和燥性，用于厥阴头痛，寒疝腹痛，寒湿脚气，经行腹痛，脘腹胀满，呕吐吞酸，五更泄泻。③盐制吴茱萸宜用于疝气疼痛。去油制霜的目的：①降低毒性，缓和药性。如巴豆（A错），有大毒，泻下作用猛烈，去油制霜后可降低毒性，缓和泻下作用，保证临床用药安全有效。②降低副作用。如柏子仁，其内含柏子仁油，具有滑肠通便之功，体虚便溏患者不宜用，制成霜后，除去了大部分油分，可降低滑肠的副作用。砂炒的目的：①增强疗效，便于调剂和制剂，如狗脊、穿山甲等。②降低毒性，如马钱子（E错）等。③便于去毛，如骨碎补等。④矫臭矫味，如鸡内金、脐带等。